患者，男性，62岁。因房颤入院用地高辛后心室率得到控制，并以0.5mg/d地高辛维持。因病人有心绞痛病史，为预防心绞痛而用一种抗心绞痛的药物，用药期间病人出现传导阻滞，你认为最可能是合并应用了哪种药物
A. 硝酸甘油
B. 硝苯地平
C. 维拉帕米
D. 硝酸异山梨酯
E. 美托洛尔

正确答案：C。维拉帕米